某女，50岁，体瘦，畏寒便溏，患崩漏、带下清稀、胃痛吞酸。宜选用的药是
A. 芡实
B. 海螵蛸
C. 椿皮
D. 桑螵蛸
E. 莲子肉

正确答案：B。海螵蛸

解析：本题考查的是海螵蛸的主治病证。体瘦，畏寒便溏，患崩漏、带下清稀、胃痛吞酸。宜选用的药是海螵蛸（B对）。海螵蛸：【主治病证】（1）崩漏下血，肺胃出血，创伤出血。（2）肾虚遗精，赤白带下。（3）胃痛吞酸。（4）湿疮湿疹，溃疡不敛。芡实（A错）：【主治病证】（1）脾虚久泻不止。（2）肾虚遗精，小便不禁，白带过多。椿皮（C错）：【主治病证】（1）久泻久痢，湿热泻痢，便血。（2）崩漏，赤白带下。（3）蛔虫病。（4）疮癣作痒。桑螵蛸（D错）：【主治病证】（1）肾阳亏虚之遗精、滑精，遗尿、尿频，小便白浊，带下。（2）阳痿不育。莲子肉（E错）：【主治病证】（1）脾虚久泻、食欲不振。（2）肾虚遗精、滑精，脾肾两虚之带下。（3）心肾不交之虚烦、惊悸失眠。